高血压脑出血的好发部位是
A. 脑干
B. 基底节
C. 小脑
D. 脑室
E. 脑叶

正确答案：B。基底节

解析：高血压脑出血的好发部位是基底节（B对）。基底节（又称基底核）主要由尾状核、豆状核、屏状核、杏仁体组成，由大脑中动脉中央支（豆纹动脉）供血，因其行程弯曲，因此在高血压动脉硬化是容易破裂。故绝大多数（70%）高血压性ICH发生在基底节的壳核及内囊区；而脑叶（E错）、脑干（A错）及小脑（C错）出血各占约10%，脑室（D错）出血仅占脑出血的3%-5%。